心脏正常起搏点位于
A. 窦房结
B. 房室交界区
C. 心房
D. 心室末梢普肯耶纤维网
E. 心室

正确答案：A。窦房结